女，18岁，右下颌膨隆畸形2年，无疼痛。如果X线表现呈多房性囊性影像，分房大小相差悬殊，颌骨膨胀明显，病变区牙根呈截根样吸收，应诊断为
A. 牙源性角化囊肿
B. 骨纤维异常增殖症
C. 含牙囊肿
D. 成釉细胞瘤
E. 颌骨中央性癌

正确答案：D。成釉细胞瘤

解析：本题考查成釉细胞瘤。根据题目中的信息可知该18岁女性患者的X线表现呈多房性囊性影像，分房大小相差悬殊，颌骨膨胀明显，病变区牙根呈截根样吸收，与成釉细胞瘤的表现一致，因此可诊断为成釉细胞瘤（D对）。角化囊肿（A错）好发于下颌第三磨牙区及下颌支部，穿刺可见黄、白色角蛋白样物质混杂其中，而成釉细胞瘤以下颌体及下颌角部为常见。骨纤维异常增殖症（B错）发展缓慢，病程长，青春期后可停止生长，也可终生缓慢进展；上颌比下颌多见，一般表现为无痛性骨膨胀，引起颜面部不对称，牙移位及咬合关系改变；典型的X线表现为病变骨区阻射性降低，呈磨玻璃样改变，病变与周围正常骨的界限不明显。含牙囊肿（C错）除下颌第三磨牙区外，上颌尖牙区也是好发部位；穿刺可得草黄色囊液，在显微镜下可见到胆固醇晶体。下唇麻木常是中央性颌骨癌（E错）的首要症状，X线片早期表现为病损局限于根尖区骨松质之内，呈不规则虫蚀状破坏；以后才破坏并浸润骨密质。